以下哪项不是自然牙牙冠表面的自洁区
A. （牙合）面
B. 颊面
C. 外展隙
D. 邻接触区
E. 舌面

正确答案：D。邻接触区

解析：本题考查自洁区。邻接触区（D错，为本题的正确答案）不是自然牙牙冠表面的自洁区。自洁区是指牙齿相互没有接触的区域，也就是唇颊舌所能接触到的牙面，包括（牙合）面（A对）、颊面（B对）、舌面（E对）、外展隙（C对）等，唇颊舌的运动可以对这些区域进行清洁，而邻接区是唇颊舌不能接触到的区域，属于非自洁区。